侵袭性牙周炎的致病菌
A. 伴放线聚集杆菌
B. 产黑色素类杆菌
C. 螺旋体
D. 牙龈卟啉菌
E. 梭形杆菌

正确答案：A。伴放线聚集杆菌

解析：本题考查侵袭性牙周炎的致病菌。伴放线聚集杆菌（A对）是侵袭性牙周炎的致病菌。产黑色素拟杆菌（B错）为口腔中的正常菌群，常与其他细菌混合感染。梭形杆菌（E错）和螺旋体（C错）广泛存在于慢性龈炎和牙周病患者的菌斑中。牙龈卟啉菌（D错）是慢性牙周炎病变区或活动部位主要的优势菌。